男，19岁。咽痛、发热伴咳嗽2周，眼睑水肿伴肉眼血尿3天。查体：BP150/100mmHg，全身皮肤无皮疹。实验室检查：尿蛋白（++），尿红细胞30～40/HP，管型3～5/LP，补体C₃降低，SCr126μmol/L。该患者最可能的诊断为
A. 急进性肾小球肾炎
B. 慢性肾小球肾炎
C. 肾病综合征
D. 急性肾小球肾炎
E. 急性肾盂肾炎

正确答案：D。急性肾小球肾炎

解析：19岁青少年男性患者，上呼吸道感染2周后起病，眼睑水肿伴肉眼血尿3天。查体：BP150/100mmHg（正常值：收缩压＜120mmHg和舒张压＜90mmHg），提示高血压；全身皮肤无皮疹。实验室检查：尿蛋白（++）（正常值：尿蛋白（-）），提示蛋白尿；尿红细胞30～40/HP（尿红细胞＞3/HP称为镜下血尿），提示血尿；管型3～5/LP，补体C₃降低，SCr126μmol/L（正常值：100±10ml/（min·1.73m²），SCr轻度升高，提示肾功能受损。综合该患者的病史、查体、实验室检査，该患者诊断考虑为急性肾小球肾炎（D对），急进性肾小球肾炎（A错）起病过程与急性肾炎相似，但除急性肾炎综合征外，多早期出现少尿、无尿，肾功能急剧恶化为特征；慢性肾小球肾炎（B错）病程应大于三个月；肾病综合征（C错）诊断应满足尿蛋白大于3.5g/d和血浆白蛋白低于30g/L。急性肾盂肾炎（E错）起病急，通常有发热（体温多在38℃以上）、寒战等全身症状和尿频、尿急、排尿困难、腰痛等泌尿系统症状。